妊娠期禁用峻下、破血、有毒药物，属于
A. 因时制宜
B. 因人制宜
C. 因地制宜
D. 因病而治
E. 反治

正确答案：B。因人制宜

解析：本题考查的是因人制宜的原则和治疗方法。妊娠期禁用峻下、破血、有毒药物，属于因人制宜（B对）。因人制宜：根据患者年龄、性别、体质、生活习惯等不同特点，来考虑治疗用药的原则，叫做“因人制宜”。1.年龄：不同年龄则生理状况和气血盈亏不同，治疗用药也应有区别。小儿生机旺盛，但气血未充，脏腑娇嫩，易寒易热，易虚易实，病情变化较快，故治小儿病，忌投峻攻，少用补益，用药量宜轻。老年人生机减退，气血亏虚，患病多虚证，或虚实夹杂，治疗虚证宜补；有实邪者攻邪要慎重，用药量应比青壮年轻。2.性别：男女性别不同，各有其生理特点，妇女有经、带、胎、产等情况，治疗用药应加以考虑。如在妊娠期，对峻下、破血、滑利、走窜伤胎或有毒药物，当禁用或慎用。产后应考虑气血亏虚及恶露有无等。3.体质：体质有强弱与寒热之偏，阳盛或阴虚之体，慎用温热之剂；阳虚或阴盛之体，慎用寒凉伤阳之药。说明体质不同，治疗用药常不同。此外，有的病者素有某些慢性病或职业病，以及情志因素、生活习惯等，在诊治时，也应注意。因时制宜（A错）：因时制宜，是指根据不同季节气候特点，来考虑治疗用药的原则。四时气候的变化，对人体的生理功能、病理变化均产生一定的影响。因时制宜的治法包括：1.用温远温；2.用热远热；3.用凉远凉；4.用寒远寒。因地制宜（C错）：根据不同地域的地理特点，来考虑治疗用药的原则，即为“因地制宜”。不同地区，由于地势高低、气候条件及生活习惯各异，人的生理活动和病变特点也不尽相同，故治疗用药应根据当地环境及生活习惯而有所变化。反治（E错），又称从治，是指顺从疾病证侯的外在假象而治的治疗法则。适用于临床表现与疾病证候本质不完全一致的病症。主要包括热因热用、寒因寒用、塞因塞用、通因通用四种治法。因病而治（D错），2022年考试指南未明确说明。